男性，25岁。发作性干咳3月，伴有夜间胸闷，无发热、咯血。查体双肺未闻及干湿啰音。为明确诊断应首选的检查是
A. 心脏彩超
B. X线胸片
C. 肺功能
D. 心电图
E. 纤维支气管镜

正确答案：B。X线胸片

解析：患者系青年男性，有发作性干咳3月，伴有夜间胸闷，无发热、咯血。查体双肺未闻及干湿啰音等，提示可能患有肺炎，为明确诊断应首选的检查是X线胸片（B对）。心脏彩超（A错）常用于心肌病等的辅助检查。肺功能（C错）常用于呼吸衰竭的患者的类型分析。心电图（D错）常用于心律失常的诊断。纤维支气管镜（E错）常用于支气管活检取组织或用于支气管肺癌的辅助检查。